以舌系带溃疡为特征的是
A. 压疮性溃疡
B. 自伤性溃疡
C. 重型阿弗他溃疡
D. Bednar溃疡
E. Riga-Fade溃疡

正确答案：E。Riga-Fade溃疡

解析：本题考查创伤性溃疡。以舌系带溃疡为特征的是Riga-Fade溃疡（E对）。李-弗溃疡（Riga-Fedeulcer）专指发生于婴幼儿舌腹的溃疡。因过短的舌系带和过锐的新萌乳中切牙长期摩擦引起，舌系带处充血、肿胀、溃疡。久不治疗则转变为肉芽肿性溃疡，扪诊有坚韧感，影响舌活动。压疮性溃疡（A错）：由持久的非自伤性机械性刺激造成。多见于老年人。残根残冠或不良修复体长期损伤黏膜，溃疡深及黏膜下层，边缘轻度隆起，色泽灰白，疼痛不明显。自伤性溃疡（B错）：好发于性情好动的青少年或患多动症的儿童。患者常有用铅笔尖捅刺黏膜不良习惯。右利手者，溃疡好发于左侧颊脂垫尖或磨牙后垫处，左利手者，溃疡位置反之。有咬唇、咬颊、咬舌不良习惯者，溃疡好发于下唇黏膜或两颊、舌背。溃疡深在，长期不愈。溃疡外形不规则，周围因为长期的机械性刺激导致白色斑块。基底略硬或有肉芽组织,疼痛不明显。有时有痒感。重型阿弗他溃疡（C错）：好发于青春期，疼痛剧烈，愈后可留瘢痕。初始好发于口角，其后有向口腔后部移行的发病趋势，发生于舌腭弓、软硬腭交界处等口腔后部时可造成组织缺损，影响言语及吞咽。常伴低热乏力等全身不适症状和溃疡局部区域的淋巴结肿痛。溃疡也可在先前愈合处再次复发，导致更大的瘢痕和组织缺损。Bednar溃疡（D错）：由婴儿吮吸拇指或过硬的橡皮奶头引起。固定发生于硬腭、双侧翼钩处黏膜表面，双侧对称性分布。溃疡表浅，婴儿哭闹不安，拒食。